母乳与牛乳相比，对母乳特点的描述中错误的是
A. 含饱和脂肪酸较多
B. 乳糖含量高
C. 含白蛋白多，酪蛋白少
D. 钙磷比例适宜
E. 铁吸收率高

正确答案：A。含饱和脂肪酸较多

解析：（P59）人乳中含不饱和脂肪酸较多（A错，为本题正确答案）。人乳中钙、磷比例适当（2：1）（D对），含乳糖多，钙吸收好（B对）。人乳中酪蛋白与乳清蛋白的比例为1：4，与牛乳（4：1）有明显差别，易被消化吸收（C对）。人乳中铁含量为0.075㎎/dl，与牛奶（0.3㎎/dl）相似，但人乳中铁吸收率（50%）高于牛奶（10%），故人乳比牛乳铁吸收率高（E对）。